导致子宫脱垂最常见的病因是
A. 从事重体力劳动
B. 长期便秘
C. 盆底肌肉发育不良
D. 盆底肌肉进行性变
E. 分娩损伤

正确答案：E。分娩损伤

解析：分娩损伤为子宫脱垂最重要的病因（E对）。从事重体力劳动、长期便秘、盆底肌肉发育不良、盆底肌肉进行性变均为子宫脱垂的病因，但不是最常见病因（ABCD错）。